若对急性心肌梗死患者行其他疾病的择期手术，最早应在心肌梗死后
A. 6个月
B. 1个月
C. 3个月
D. 2个月
E. 2周

正确答案：A。6个月

解析：急性心肌梗死发病后6个月内，不宜施行择期手术。6个月以上且无心绞痛发作，可在良好的监护条件下施行手术（A对）。